脾脏的描述，不正确的为
A. 位于左季肋区
B. 其长轴与第10肋一致
C. 后缘有脾切迹,是触诊脾的标志
D. 为淋巴器官
E. 脾也有造血、储血功能

正确答案：C。后缘有脾切迹,是触诊脾的标志

解析：脾上缘有切迹，是脾肿大触诊标志（C错，为本题正确答案）。脾位于左季肋区（A对）。脾的长轴与第十肋一致（B对）。淋巴器官包括淋巴结、胸腺、脾、扁桃体（D对）。脾具有储血、造血（E对）、清除衰老红细胞和进行免疫应答的功能。